秦某是一所中医药大学中医学专业硕士毕业生，已获得硕士学位，在校期间学过中药材栽培技术，具有中药材辨识能力。临近毕业时，准备参加执业药师职业资格考试，但因专业工作年限不符合报名条件，未能参加考试。秦某的老家在边远山区，交通不便，为解决家乡群众看病难题，秦某毕业后主动返乡当村医。平时除给乡邻治病之外，还在自家地里种植地产中药材。秦某报考执业药师（中药学）职业资格考试，符合规定的专业工作最低年限应当为
A. 毕业后，在中药学岗位上工作满4年
B. 毕业后，在中药学岗位上工作满3年
C. 毕业后，在中药学岗位上工作满2年
D. 毕业后，在中药学岗位上工作满1年

正确答案：C。毕业后，在中药学岗位上工作满2年

解析：本题考查的是执业药师职业资格考试报名条件。秦某是一所中医药大学中医学专业硕士毕业生，已获得硕士学位，在校期间学过中药材知识和栽培技术，具有中药材辨识能力。临近毕业时，准备参加执业药师职业资格考试，但因专业工作年限不符合报名条件，未能参加考试。秦某的老家在边远山区，交通不便，为解乡群众看病难题，毕业后主动返乡当村医。平时除给乡邻治病之外，还在自家地里种植地产中药材。秦某报考执业药师（中药学）职业资格考试，符合规定的专业工作最低年限应当为毕业后，在中药学岗位上工作满2年（C对）。凡中华人民共和国公民和获准在我国境内就业的外籍人员，具备以下条件之一者，均可申请参加执业药师职业资格考试：①取得药学类、中药学类专业大专学历，在药学或中药学岗位工作满5年；②取得药学类、中药学类专业大学本科学历或学士学位，在药学或中药学岗位工作满3年（B错）；③取得药学类、中药学类专业第二学士学位、研究生班毕业或硕士学位，在药学或中药学岗位工作满1年（D错）；④取得药学类、中药学类专业博士学位；⑤取得药学类、中药学类相关专业相应学历或学位的人员，在药学或中药学岗位工作的年限相应增加1年。